Ⅰ度腭裂是指
A. 腭垂裂
B. 软腭裂开
C. 硬腭裂开
D. 软、硬腭裂开
E. 全腭裂开包括牙槽突裂

正确答案：A。腭垂裂

解析：国内有些单位还有一种常用的腭裂分类法，即将其分为三度：Ⅰ度：限于腭垂裂。Ⅱ度：部分腭裂，裂开未到切牙孔；根据裂开部位又分为浅Ⅱ度裂，仅限于软腭：深Ⅱ度裂，包括一部分硬腭裂开（不完全性腭裂）。Ⅲ度：全腭裂开，由腭垂到切牙区，包括牙槽突裂，常与唇裂伴发。掌握“腭裂”知识点。